介导NK细胞发挥ADCC的分子是
A. CD16
B. CD32
C. CD23
D. CD64
E. CD89

正确答案：A。CD16

解析：CD16+、CD56+、CD3-、CD31、CD30是NK细胞。掌握“白细胞分化抗原及黏附分子”知识点。